治疗高位肛瘘时，宜首选
A. 切开法
B. 切除法
C. 结扎法
D. 挂线法
E. 切开加挂线法

正确答案：E。切开加挂线法

解析：肛漏是指直肠、肛管与肛门周围皮肤相通所形成的瘘管。多由肛门痈溃后脓水淋漓、久不收口所致。西医称之为肛瘘。肛漏一般以手术治疗为主，分为挂线疗法和切开疗法，挂线疗法适用于距离肛门4cm以内，有内、外口的低位肛漏；亦作为复杂性肛瘘切开疗法或切除疗法的辅助方法。切开疗法适用于低位单纯性肛漏和低位复杂性肛漏；对高位肛漏切开时，必须配合挂线疗法，以免造成肛门失禁（E对）。结扎法主要用于痔疮的治疗（C错）。